男性，48岁，右季肋区疼痛半年。CT检查示：肝右叶12cm×10cm肿块，包绕、压迫下腔静脉，肝左叶内多个小的低密度结节。进一步检查确诊为原发性肝癌。考虑的治疗方法不包括
A. 肝动脉结扎术
B. 肝动脉栓塞术
C. 肝动脉灌注化疗
D. 肝移植手术
E. 肝叶切除术

正确答案：E。肝叶切除术